食品在细菌作用下发生变化的程度与特征主要取决于
A. 细菌来源
B. 环境温度
C. 细菌菌相
D. 菌落总数
E. 食品本身理化特性

正确答案：C。细菌菌相

解析：本题考查食品在细菌作用下发生变化的程度与特征的取决因素。将共存于食品中的细菌种类及其相对数量的构成称为食品的细菌菌相（C对ABDE错），它决定了食品在细菌作用下发生腐败变质的程度与特征。